男，40岁，烧伤后3小时入院。疼痛剧烈，感口渴。面色苍白，心率150次/min，BP85/65mmHg，头颈部、躯干部布满大小不等水疱，可见潮红创面。两上肢呈焦黄色，无水疱。该病员的烧伤总面积估计为
A. 7×9%
B. 6×9%
C. 5×9%
D. 4×9%
E. 3×9%

正确答案：B。6×9%

解析：根据中国新九分法（P138 表13-1），计算该患者的烧伤总面积为：9%×1（头颈部）＋9%×3（躯干部）＋9%×2（双上肢）＝6×9%（B对）。